病人坐时常以手抱头，头倾不能昂者，属
A. 肺实气逆
B. 体弱气虚
C. 肝阳化风
D. 精神衰败
E. 气血俱虚

正确答案：D。精神衰败

解析：“坐时常以手抱头，头倾不能昂，凝神熟视，为精神衰败”（D对）。肺实气逆表现为坐而仰首（A错）。体弱气虚表现为坐而喜俯，少气懒言(B错)。肝阳化风和气血俱虚表现为但卧不能坐，坐则晕眩，不耐久坐（CE错）。